慢性龈炎的表现有
A. 疼痛明显
B. 牙周袋形成
C. 牙齿不松动
D. X线示牙槽骨有水平吸收
E. 牙齿移位

正确答案：C。牙齿不松动

解析：本题考查慢性龈炎的表现。慢性龈炎的表现有牙齿不松动（C对）。牙龈炎临床表现无自发性出血，在咬硬物和刷牙时出血，色泽鲜红暗红，龈缘变厚，龈乳头肥大，牙龈质地松软脆弱，龈沟深度在3mm以上，牙龈探诊出血，龈沟液增多。急性坏死溃疡性龈炎疼痛明显而非慢性龈炎（A错）。牙周袋形成为牙周炎的特点，而非慢性龈炎（B错）。牙槽骨吸收亦为牙周炎的特点，支持组织的丧失是这是牙周炎与牙龈炎的区别（D错）。纤维瘤病增生的牙龈覆盖部分或整个牙冠，以妨碍咀嚼，牙齿常因增生的牙龈而发生移位（E错）。